以下不是口腔白色角化病的好发部位的是
A. 硬腭
B. 唇红
C. 口底
D. 舌背
E. 颊黏膜

正确答案：C。口底

解析：本题考查口腔白色角化病的好发部位。口底（C错，为本题的正确答案）不是口腔白色角化病的好发部位。口腔白色角化症又称口腔白色角化病、良性角化病、前白斑，为长期的机械性或化学刺激所造成的口腔黏膜局部白色角化斑块或斑块或斑片。白色角化症可发生在口腔黏膜的任何部位，以唇（B对）、颊（E对）、舌（D对）多见，也可发生于硬腭（A对）黏膜及其牙龈。